热觉感受器为
A. Meckel环形小体
B. 克劳斯终球
C. 鲁非尼小体
D. 游离神经末梢
E. Meissner触觉小体

正确答案：C。鲁非尼小体

解析：本题考查口腔黏膜温度觉感受器。热觉感受器为鲁非尼小体（C对）。热觉感受器为鲁菲尼小体，冷觉感受器为克劳斯终球（B错）。痛觉感受器为游离神经末梢（D错）。口腔黏膜触压觉的感受器主要有四种：①游离神经末梢；②牙周膜本体感受器；③Meckel环形小体（A错）；④Meissner触觉小体（E错）。